钳刮术中见黄色脂肪样组织，不恰当的处理是
A. 抗感染
B. 停止宫腔操作
C. 肌注子宫收缩剂
D. 立即行剖腹探查术
E. 住院观察，有内出血征象行剖腹探查术

正确答案：D。立即行剖腹探查术

解析：钳刮术中见黄色脂肪样组织，提示子宫穿孔。恰当的处理是：应立即停止手术（B对）；穿孔小，无脏器损伤或内出血，且手术已完成时，可肌注子宫收缩剂（C对）保守治疗，并给予抗生素预防感染（A对），同时密切观察血压、脉搏等生命体征；子宫穿孔破口大、有内出血或怀疑脏器损伤，应剖腹探查或腹腔镜检查（E对），而不是立即行剖腹探查术（D错，为本题正确答案）。